以下关于颊肌的论述中，不恰当的说法是
A. 颊肌呈四边形，位于大部分唇周围肌的深面
B. 颊肌纤维向前交叉参与口轮匝肌的组成
C. 颊肌纤维最上方和最下方的肌纤维无交叉
D. 主要作用闭唇，封闭口腔
E. 颊肌位于口腔黏膜的浅面

正确答案：D。主要作用闭唇，封闭口腔

解析：颊肌呈四边形，位于大部分唇周围肌的深面，口腔黏膜的浅面，起自上、下颌骨第三磨牙根尖牙槽突的外面和翼突下颌缝（又名咽颊肌缝或翼下颌韧带，为颊肌与咽上缩肌之间的致密结缔组织），止于口角、上下唇和颊部的皮下。颊肌纤维向前交叉参与口轮匝肌的组成；但最上方和最下方的肌纤维无交叉。主要作用是牵拉口角向后。掌握“表情肌、舌腭肌”知识点。